流感防疫措施
A. 隔离病人
B. 终末消毒
C. 两者均要
D. 两者均不要

正确答案：A。隔离病人

解析：本题考查流感防疫措施。流感即流行性感冒，属于我国法定报告丙类传染病，其防疫措施是隔离病人（A对），将其与周围易感者分隔开来，减少或消除病原体扩散。终末消毒是当传染源痊愈、死亡或离开后对疫源地进行的彻底消毒，从而清除传染源所播散在外界环境中的病原体。流感一般不需要进行终末消毒（BCD错）。